在meta分析中，若入选的研究存在严重的异质性，合并效应时最好采用下列分析方法中的
A. 固定效应模型分析
B. 随机效应模型分析
C. 亚组分析
D. 敏感性分析
E. 漏斗图分析

正确答案：C。亚组分析

解析：本题考查亚组分析。亚组分析是指针对不同研究特征进行资料的分析，例如将研究对象根据年龄、性别、病情轻重，干预措施不同的剂量或疗程等进行比较，主要目的是探讨临床异质性的来源，即识别效应修饰因素或评价交互作用。在meta分析中，若入选的研究存在严重的异质性，合并效应时最好采用亚组分析（C对ABDE错）。